对生产工艺流程、生产设备布局、化学反应原理、所选原辅材料及其所含有毒杂质的名称、含量等进行分析，推测可能存在的职业危害因素的方法属于
A. 类比法
B. 检査表法
C. 工程分析法
D. 职业流行病学调査
E. 检验、检测法

正确答案：C。工程分析法